猩红热可见的舌改变是
A. 牛肉舌
B. 毛舌
C. 草莓舌
D. 裂纹舌
E. 镜面舌

正确答案：C。草莓舌

解析：猩红热病情初期为“草莓舌”（C对）改变，2～3天后为“杨梅舌”改变。牛肉舌（A错）见于干燥综合征、真菌感染等疾病。毛舌（B错）可见于糖尿病、获得性免疫缺陷综合征等。裂纹舌（D错）见于银屑病、口干症、伤寒、梅毒感染、梅-罗综合征等。镜面舌（E错）见于贫血、消化功能紊乱、偏食或营养得不到充分供给，微生物感染等。